患者，女，45岁。因淋雨后突发小便频急短数，刺痛灼热，尿色黄赤，口苦，舌苔黄腻，脉濡数。治疗应首选
A. 八正散
B. 小蓟饮子
C. 导赤散
D. 石韦散
E. 茜根散

正确答案：A。八正散

解析：本患者以小便频急短数，刺痛灼热为主，故诊断为淋证；膀胱气化失司，是热淋的主要病机，故见小便频急短数，刺痛灼热，尿色黄赤；湿热内蕴，邪正相争，可见口苦；舌苔黄腻，脉濡数，均为湿热的表现，故诊断为热淋；其治法为清热利湿通淋，代表方为八正散（A对）。小蓟饮子，其功用为清热通淋，凉血止血，可用于治疗血淋证(B错)。导赤散，其功用为清心利水养阴，适用于治疗心经火热证（C错）。石韦散，其功用为清热利湿，排石通淋，可用于治疗石淋证（D错）。茜根散，其功用为滋阴降火，宁络止血，适用于治疗紫斑之阴虚火旺证（E错）。